在经络系统中，具有离、入、出、合循行特点的是
A. 奇经八脉
B. 十二经别
C. 十二经筋
D. 十二皮部
E. 十五络脉

正确答案：B。十二经别

解析：奇经八脉指别道奇行的经脉，包括督脉、任脉、冲脉、带脉、阴维脉、阳维脉、阴跷脉、阳跷脉共8条。除带脉横向循行外，其余均为纵向循行，纵横交错的循行分布于十二经脉之间（A错）。十二经筋的循行分布均起始于四肢末端，结聚于关节、骨骼部，走向躯干头面。十二经筋行于体表，不入内脏（C错）。十二皮部是十二经脉功能活动反映于体表的部分，也是络脉之气散布之所在。其分布区域是以十二经脉在体表的分布范围，即十二经脉在皮肤上的分属部分为依据划分的（D错）。十二经脉和任、督二脉各自别出一络，加上脾之大络，统称为十五络脉。十二经脉的别络均从本经四肢肘膝关节以下的络穴分出，走向其相表里的经脉，即阴经别络走向阳经，阳经别络走向阴经（E错）十二经别是正经别行深入体腔的支脉，是十二正经离、入、出、合的别行部分。